学生人数不足600人的学校可以配备（），开展学校卫生工作
A. 一名医生和一名兼职保健教师
B. 一名护士和一名兼职保健教师
C. 专职或兼职保健教师
D. 专职或兼职健身教练
E. 专职卫生技术人员

正确答案：C。专职或兼职保健教师